造成牙槽骨吸收速度快的原因不是
A. 骨质疏松
B. 牙周病
C. 猖獗龋
D. 全身健康差
E. 义齿设计制作不合理

正确答案：C。猖獗龋

解析：本题考查造成牙槽骨吸收速度快的原因。猖獗龋（C错，为本题的正确答案）特征性表现是在短时间内出现明显龋洞，龋病不会加速牙槽骨的吸收。骨质疏松（A对）患者的骨质密度低，其牙槽骨吸收速度较快。牙周病（B对）患者特征性表现有牙槽骨的吸收，因此牙周病引起的牙列缺失其牙槽嵴吸收往往在初期就很明显。全身健康状态差（D对）的患者牙槽嵴吸收速度快。义齿设计制作不合理（E对），会局部压迫牙槽嵴，牙槽嵴是全身最活跃的骨组织，有受压迫吸收的特点。